关于儿童营养需求特点，正确的是
A. 儿童消化、代谢与成人相同
B. 各种营养素的需要量与成人一样
C. 个体之间营养需求差异不明显
D. 生长高峰期营养素的需求量增加
E. 年龄愈小营养缺乏病愈少

正确答案：D。生长高峰期营养素的需求量增加

解析：本题考查儿童发育的营养需求。儿童的营养需求特点：1.能量与营养素的需要量高于（B错）成年人；2.生长发育高峰期的需求量明显增加（D对）；3.年龄越小，患营养缺乏症的危险性越大（E错）。儿童的消化功能比成人的较差（A错），容易受食物影响感染细菌。儿童对各种营养素的需要量与成人不同，且各年龄组间对营养需求明显有差异（C错）。